下列药物中，有效血药浓度与中毒浓度距离相近的是
A. 阿司匹林
B. 苯妥英钠
C. 阿托品
D. 氢氯噻嗪
E. 四环素

正确答案：B。苯妥英钠